毛果芸香碱滴眼可产生哪种作用
A. 近视、扩瞳
B. 近视、缩瞳
C. 远视、扩瞳
D. 远视、缩瞳
E. 虹膜角膜角变窄

正确答案：B。近视、缩瞳

解析：毛果芸香碱激动睫状肌M受体使环状肌纤维向瞳孔中心方向收缩，造成悬韧带放松，晶状体由于本身弹性变凸，屈光度增加，此时只适合于视近物，而难以看清远物，造成近视（B对D错）。毛果芸香碱属于M受体激动剂，能直接作用于副交感神经节后纤维支配的效应器官的M胆碱受体，尤其对眼和腺体作用较明显，虹膜内有两种平滑肌，一种是瞳孔括约肌，受动眼神经的副交感神经纤维支配，另一种是瞳孔扩大肌，受肾上腺素能神经支配，毛果芸香碱可激动瞳孔括约肌的M胆碱受体，使瞳孔括约肌收缩，瞳孔缩小（AC错）。毛果芸香碱通过缩瞳作用使虹膜向眼球中心拉紧，虹膜根部变薄，从而使处于虹膜周围的前房角间隙扩大，虹膜角膜角变大（E错），房水易于经滤帘进入虹膜静脉窦，使眼内压下降，临床可用于治疗青光眼。